为尽量保留健康牙体组织以下操作正确的是
A. 洞形做最小程度的扩展
B. 窝洞的龈缘尽量位于牙龈边缘的（牙合）方
C. 尽量不做预防性扩展
D. 有发育缺陷的点隙裂沟可用窝沟封闭等处理预防
E. 以上都正确

正确答案：E。以上都正确

解析：本题考查窝洞预备的基本原则-尽量保留健康的牙体组织。为尽量保留健康牙体组织，窝洞预备的要求有：洞形应做最小程度的扩展（A对），窝洞的龈缘尽量位于牙龈边缘的（牙合）方（B对），尽量不做预防性扩展（C对），有发育缺陷的点隙裂沟可用窝沟封闭等处理预防（D对），（ABCD均对，故E为本题的正确答案）。